在各种生物学、心理学以及社会环境因素影响下，造成中枢神经系统功能失调，进而导致精神活动异常为主要临床表现的疾病，称为
A. 精神障碍
B. 心身疾病
C. 传染病
D. 神经衰弱
E. 精神病

正确答案：A。精神障碍

解析：本题考查精神障碍概述。精神障碍（A对），又称精神疾病，是指在各种生物学、心理学以及社会环境因素影响下，造成中枢神经系统功能失调，进而导致以认知、情感、意志和行为等各种精神活动异常为主要临床表现的一类疾病的总称。精神病只是精神障碍中的一小部分，仅指具有幻想、妄想等“精神病性症状”的精神障碍。